关于特殊使用级抗菌药物的说法，正确的有
A. 疗效、安全性方面的临床资料丰富
B. 具有明显或者严重不良反应，不宜随意使用的
C. 价格昂贵
D. 需要严格控制使用，避免细菌过快产生耐药

正确答案：B、C、D。具有明显或者严重不良反应，不宜随意使用的；价格昂贵；需要严格控制使用，避免细菌过快产生耐药

解析：本题考查特殊使用级抗菌药物分级和分级标准。说法正确的有具有明显或者严重不良反应，不宜随意使用的（B对）、价格昂贵的（C对）、需要严格控制使用，避免细菌过快产生耐药的（D对）。特殊使用级主要包括以下几类：①具有明显或者严重不良反应，不宜随意使用的抗菌药物；②需要严格控制使用，避免细菌过快产生耐药的抗菌药物；③疗效、安全性方面的临床资料较少的（A错）抗菌药物；④价格昂贵的抗菌药物。